关于交通支的描述，错误的是
A. 分灰、白交通支
B. 白交通支含节前纤维
C. 灰交通支含节后纤维
D. 胸、腰神经均有白交通支
E. 每对脊神经均有灰交通支

正确答案：D。胸、腰神经均有白交通支

解析：交通支分为白、灰交通支（A对），白交通支由于位脊髓Tl~L3节段的脊髓侧角的节前纤维组成（B对），灰交通支由交感干神经节细胞发出的节后纤维组成（C对）。白交通支只存在于Tl~L3各脊神经的前支与相应的交感干神经节之间（D错，为本题正确选项）。灰交通支连于交感干与31对脊神经前支之间（E对）。